动脉粥样硬化的预防措施不包括
A. 控制肥胖及超重
B. 多吃蔬菜、瓜果
C. 减少动物脂肪的摄入
D. 少食含不饱和脂肪酸较多的植物油
E. 戒烟忌酒

正确答案：D。少食含不饱和脂肪酸较多的植物油